ASO增高。心电图示一度房室传导阻滞，ST段下移，T波平坦。该患儿需绝对卧床休息的时间是
A. 4周
B. 3周
C. 6周
D. 8周
E. 10周

正确答案：A。4周

解析：6岁患儿，发热2个月，心悸1个月，并左膝关节痛，双肘、腕关节红肿，偶有胸闷，口服抗生素疗效不佳（发热和关节炎是风湿热的常见主诉），T38.2℃，心率134次/分（体温升高，心率加快），第一心音减弱，心尖区可闻及吹风样收缩期杂音，偶可闻及早搏，心电图示一度房室传导阻滞，ST段下移，T波平坦（提示心脏炎），实验室检查：WBC 12×10⁹/L，N 0.8，ESR 40mm/h，血 ASO增高（有链球菌感染证据），综上考虑诊断为风湿热。卧床休息的期限取决于心脏受累程度和心功能状态。患儿有心脏炎而无心力衰竭，建议卧床休息4周（A对）。